下颌尖牙形态中哪一点是错误的
A. 近中牙尖嵴较远中牙尖嵴短
B. 唇面五边形
C. 牙尖偏近中
D. 舌轴嵴较上颌尖牙显著
E. 发育沟不明显

正确答案：D。舌轴嵴较上颌尖牙显著

解析：上颌尖牙颈嵴、轴嵴和舌隆突较明显，舌窝较深；下颌尖牙颈嵴、轴嵴和舌隆突不明显，舌窝较浅。掌握“上下颌前牙的外形及临床应用解剖”知识点。